较易引起低输出量性心力衰竭的原因是
A. 二尖瓣关闭不全
B. 维生素B1缺乏
C. 动-静脉瘘
D. 严重贫血
E. 甲状腺功能亢进

正确答案：A。二尖瓣关闭不全

解析：心力衰竭按照心排血量可分为低输出量性心力衰竭和高输出量性心力衰竭。低输出量性心力衰竭病人的心排血量低于正常群体的平均水平，常见于冠心病、高血压、心脏瓣膜病（A对）以及心肌炎等引起的心功能不全，此时外周血管阻力增加，患者可有血管收缩、四肢发冷、苍白、脉压减小和动静脉血氧含量差增大的表现。高输出量性心力衰竭见于严重贫血（D错）、甲亢（E错）、妊娠、动-静脉瘘（C错）以及维生素B₁缺乏症（B错），此时外周血管阻力降低、血容量扩大（循环速度加快），静脉回心血量增加，心脏过度充盈，代偿阶段其心排血量明显高于正常，处于高动力循环状态，此时一旦发展至心功能不全，心排血量将会较心功能不全前有所下降，但仍然高于或不低于正常群体的平均水平。